下列哪组致癌物为非遗传毒性致癌物
A. 免疫抑制剂，无机致癌物，促癌剂
B. 免疫抑制剂，过氧化物酶体增生剂，促癌剂
C. 直接致癌物，过氧化物酶体增生剂，细胞毒物
D. 激素，固态物质，无机致癌物

正确答案：B。免疫抑制剂，过氧化物酶体增生剂，促癌剂

解析：本题考查非遗传毒性致癌物。非遗传毒性致癌物泛指不直接作用于机体遗传物质的致癌物。免疫抑制剂，过氧化物酶体增生剂，促癌剂（B对ACD错）均为非遗传毒性致癌物。